女，23岁。遵医嘱需肌内注射，在注射室内尚有男患者时，护士让该患者露出臀部进行注射，引起她的不满，护士则认为来看病就无须避嫌。该护士的观点和做法违背的伦理原则
A. 公正原则
B. 尊重原则
C. 不伤害原则
D. 公益原则
E. 有利原则

正确答案：B。尊重原则

解析：在注射室内尚有男患者时，护士让患者露出臀部进行注射，侵犯了患者的隐私。这种做法违背了医学伦理学基本原则中的尊重原则（B对）。